肩胛骨下角平对
A. 第4肋
B. 第5肋
C. 第6肋
D. 第7肋
E. 第8肋

正确答案：D。第7肋

解析：肩胛骨下角平对第 7 肋或第 7 肋间隙，为计数肋的标志（D对）。